男，36岁，平素体健。淋雨后发热，咳嗽2天，右上腹痛伴气急恶心1天。首选的治疗药物是
A. 解热镇痛药
B. 庆大霉素
C. 苄星青霉素
D. 头孢他啶
E. 胃肠道解痉剂

正确答案：C。苄星青霉素

解析：患者为青中年男性（为肺炎链球菌肺炎的好发年龄），平素体健，淋雨后发热、咳嗽2天（肺炎链球菌肺炎发病前常有受凉、淋雨史），右上腹痛伴气急恶心1天，根据其临床表现和体征，考虑诊断为肺炎链球菌肺炎，首选的治疗药物是青霉素G（苄星青霉素）（C对）。解热镇痛药（A错）用于发热、疼痛的对症支持治疗。肺炎链球菌为革兰染色阳性球菌，庆大霉素（B错）对G⁻杆菌的主要抗菌药。头孢菌素（D错）主要用于G⁺菌、G⁻菌的治疗，可用于肺炎链球菌肺炎的治疗，但非首选用药。胃肠解痉药（E错）可用于缓解腹痛的对症治疗。